坏疽性口炎的首选药物为
A. 青霉素
B. 无环鸟苷
C. 皮质激素
D. 制霉菌素
E. 交沙霉素加甲硝唑

正确答案：E。交沙霉素加甲硝唑

解析：本题考查坏疽性口炎的治疗。坏疽性口炎是由梭形杆菌和螺旋体感染为主要病因的。因此治疗时可给与广谱抗生素，同时联合应用抗无芽孢厌氧菌活性较强的药物如甲硝唑，交沙霉素是新型大环内酯类广谱抗生素，因此坏疽性口炎的治疗可首选交沙霉素加甲硝唑（E对）。青霉素（A错）是广谱抗生素，但单独应用时厌氧菌的治疗力度不足。无环鸟苷（B错）用于单纯疱疹病毒感染。皮质激素（C错）用于变态反应性疾病的治疗。制霉菌素（D错）能抑制真菌和皮藓菌的活性，常用于口腔念珠菌病的治疗。